体重为55kg的成年慢性贫血患者，输注1单位悬浮红细胞可提高血红蛋白的量约是
A. 1g/L
B. 5g/L
C. 10g/L
D. 15g/L
E. 2g/L

正确答案：B。5g/L

解析：成年人全身血浆含量占体重的5%，正常成年男性血细胞比容为40%-50%，取平均值45%，则可计算出正常成年人全身血液含量约占体重9%，55kg成年人全身血液约为4.95L。成年男性血红蛋白的正常值为120～160g/L，去平均值140g/L。1单位悬浮红细胞（一个单位200ml）含血红蛋白的量为140g/L*0.2L＝28g，故输注1单位悬浮红细胞可提高血红蛋白的量约是28g/4.95L≈5.7g/L（B对）。